男，35岁，诊断为肝炎肝硬化失代偿期，一周来出现轻微腹痛，腹水增多。查体：T38.5℃，腹水常规：测黄色，比重为1.016，蛋白25g/L，白细胞500×10⁶/L，中性粒细胞0.85，最可能的并发症是
A. 原发性肝癌
B. 脾栓塞
C. 自发性腹膜炎
D. 门静脉血栓形成
E. 结核性腹膜炎

正确答案：C。自发性腹膜炎

解析：中年男性患者，诊断为肝炎肝硬化失代偿期。一周来出现轻微腹痛，腹水增多， T38.5℃（中度发热），符合自发性腹膜炎的特点：发热、腹痛、腹水增加。腹水常规：黄色，比重为1.016，蛋白25g/L，白细胞500×10⁶/L，以中性粒细胞为主，提示腹水介于漏出液和渗出液之间。综合患者病史、体检与腹水检查，考虑诊断为自发性细菌性腹膜炎（C对）。原发性肝癌（P416）（A错）表现为肝区疼痛、肝大、黄疸、肝硬化征象、进行性消瘦、发热、食欲不振、乏力、营养不良和恶病质等，其腹水一般呈漏出液表现。脾栓塞（B错）与慢性胰腺炎关系密切，主要表现为非肝硬化性门脉高压。结核性腹膜炎（P370）（E错）腹水表现为渗出液，蛋白质定量在30g/L以上，白细胞以淋巴细胞或单核细胞为主。门静脉血栓形成（P409）（D错）急性或亚急性发展时，表现为中、重度腹胀痛或突发剧烈腹痛、脾大、顽固性腹水、肠坏死、消化道出血及肝性脑病等，腹穿可抽出血性腹水。